胃脘疼痛如针刺状，痛处固定，大便色黑，证属
A. 胃寒
B. 气滞
C. 食积
D. 胃气虚
E. 血瘀

正确答案：E。血瘀